“七恶”中，症见“皮肤枯槁，痰多音喑，呼吸喘急，鼻翼煽动”者，称为
A. 心恶
B. 肝恶
C. 脾恶
D. 肺恶
E. 气血衰竭

正确答案：D。肺恶

解析：本题考查七恶的内容，需理解记忆。七恶包括心恶、肝恶、脾恶、肺恶、肾恶、脏腑败坏、气血衰竭（脱证）。其中肺恶为皮肤枯搞，痰多音暗，呼吸喘急。鼻翼煽动（D对）。心恶，为神志昏惚，心烦舌燥，疮色紫黑，言语呢喃（A错）。肝恶，为身体强直，目难正视，疮流血水，惊悸时作（B错）。脾恶，为形容消瘦，疮陷脓臭，不思饮食，纳药呕吐（C错）。气血衰竭，为疮陷色暗，时流污水，汗出肢冷，嗜卧语低（E错）。